最简便易行的腹部实质性脏器病变检查方法是
A. 纤维内窥镜检查
B. CT扫描
C. 同位素扫描
D. B超检查
E. X线摄片

正确答案：D。B超检查

解析：腹部实质性脏器主要包括肝、胆、胰、脾，对这些实质性脏器病变最简便易行的检查方法是B超检查（D对）。纤维内窥镜检查（A错）、X线摄片（E错）较少用于检查腹部实质性脏器病变。CT扫描（B错）、同位素扫描（C错）多用于腹部实质性脏器的进一步检查，一般不作为首选检查。